某小学组织学生接种乙肝疫苗，有数名学生出现头痛，呕吐，四肢乏力，因而送医院就诊，首诊医生及时处理并报告医院有关部门，经医护人员解释，安抚后，39名学生未经治疗症状很快消失，5名学生仍有恶心，并伴有焦虑，医院组织专家会诊后排除疫苗和其他躯体疾病所致。根据《疫苗流通与预防接种管理条例》，该事件所出现的情况属于
A. 药品不良反应
B. 预防接种异常反应
C. 医疗事故
D. 突发公共卫生事件
E. 群体性心因性反应

正确答案：E。群体性心因性反应